确定分析方法的检测限是，一般要求信噪比为
A. 1∶1
B. 3∶1
C. 5∶1
D. 10∶1
E. 20∶1

正确答案：B。3∶1

解析：本题考查信噪比。一般以信噪比为3:1（B对）或2:1时相应的浓度或注入仪器的量确定检查线。